临床常用的酸蚀剂
A. 10％～30％柠檬酸
B. 10％～15％磷酸
C. 30％～50％磷酸
D. 30％～50％醋酸
E. 10％～15％醋酸

正确答案：C。30％～50％磷酸

解析：本题考查临床常用的酸蚀剂。临床常用的酸蚀剂为30％～50％磷酸（C对），目前最常用的是37%的磷酸。